传导舌后1/3味觉的第一级神经元的胞体位于
A. 三叉神经节
B. 前庭神经节
C. 膝神经节
D. 舌咽神经的下神经节
E. 无

正确答案：D。舌咽神经的下神经节

解析：舌咽神经发出一般内脏感觉纤维，其神经元胞体位于颈静脉孔处的下神经节（D对），周围突分布于咽、舌后1/3、咽鼓管和鼓室等处黏膜。